单侧腮腺手术的体位是
A. 平卧头正位
B. 平卧头侧位
C. 平卧仰头位
D. 平卧低头位
E. 平卧垫肩头侧位

正确答案：B。平卧头侧位

解析：一侧的腮腺手术，只有头侧位才能较好的暴露腮腺区手术野。掌握“口外手术组织切开、止血及组织分离”知识点。